反映药物内在活性的是
A. 最小有效量
B. 效能
C. 效价强度
D. 治疗指数
E. 安全范围

正确答案：B。效能

解析：本题考查效能和效价。反映药物内在活性的是效能（B对）。在一定范围内，增加药物剂量或浓度，其效应随之增加，但效应增至一定程度时，若继续增加剂量或浓度而效应不再继续增强，此药理效应的极限称为最大效应，也称效能。效能反映了药物的内在活性，在质反应中阳性率100%。最小有效量（A错）是指引起药理效应的最小药物剂量，也称阈剂量。效价强度（C错）是指能引起等效反应（一般采用50%效应量）的相对剂量或浓度。效价强度用于作用性质相同的药物之间的等效剂量或浓度的比较，其值越小则强度越大。治疗指数（D错）是指药物LD₅₀与ED₅₀的比值，其表示药物的安全性，此数值越大越安全。安全范围（E错）是指ED₉₅和LD₅之间的距离，其值越大越安全。